全身麻醉术后未清醒时最合适的体位是
A. 仰卧位
B. 侧卧位
C. 半坐卧位
D. 平卧头偏一侧
E. 头低脚高位

正确答案：D。平卧头偏一侧

解析：全身麻醉时因病人意识丧失，吞咽及咳嗽反射丧失，贲门松弛，胃内容物较多时，极易发生呕吐或胃内容物反流，一旦有反流物到达咽喉部，即可发生误吸，造成窒息或吸入性肺炎。所以应该将患者平卧并且头偏向一侧（D对），使呕吐物容易引出口腔外，避免进入呼吸道。